秦艽的原植物属于
A. 龙胆科
B. 葡萄科
C. 蔷薇科
D. 豆科
E. 五加科

正确答案：A。龙胆科

解析：本题考查的是秦艽的来源。秦艽的原植物属于龙胆科（A对）。秦艽【来源】为龙胆科植物秦艽、麻花秦艽、粗茎秦艽或小秦艽的干燥根，前三种按性状不同分别习称“秦艽”和“麻花艽”，后一种习称“小秦艽”。白蔹【来源】葡萄科（B错）植物白蔹的根。地榆【来源】为蔷薇科（C错）植物地榆或长叶地榆的干燥根。后者习称“绵地榆”。槐花【来源】本品为豆科（D错）植物槐的干燥花及花蕾。前者称“槐花”，后者称“槐米”。三七【来源】本品为五加科（E错）植物三七的干燥根及根茎。